影响能量代谢最主要的因素是
A. 寒冷
B. 高温
C. 肌肉活动
D. 精神活动
E. 进食

正确答案：C。肌肉活动